某患者拔除上颌第二磨牙，2小时后仍出血不止。检查发现到颊侧牙龈撕裂，渗血明显，最好采用以下哪种方法止血
A. 结扎颈外动脉
B. 碘仿纱条填塞
C. 全身应用止血药物
D. 缝合撕裂牙龈
E. 明胶海绵+纱球压迫

正确答案：D。缝合撕裂牙龈

解析：缝合撕裂牙龈，可使微小血管腔闭塞，从而达到止血效果。掌握“口外手术组织切开、止血及组织分离”知识点。